平均滞留时间是
A. Cmax
B. t1/2
C. AUC
D. MRT
E. Css（平均稳态血药浓度）

正确答案：D。MRT

解析：本题考查药动学参数。MRT（D对）为药物在体内的平均滞留时间；单室模型血管外途径给药，血药浓度-时间关系为单峰曲线，Cmax（A错）为其峰浓度；t1/2（B错）为生物半衰期；AUC（C错）表示血药浓度-时间曲线下面积；Css（E错）表示稳态血药浓度。